受体激动剂的特点是
A. 与受体有亲和力，有内在活性
B. 与受体有亲和力，无内在活性
C. 与受体无亲和力，有内在活性
D. 与受体有亲和力，有弱的内在活性
E. 与受体有弱亲和力，有强的内在活性

正确答案：A。与受体有亲和力，有内在活性